经皮吸收制剂常用的压敏胶有
A. 聚异丁烯
B. 聚乙烯醇
C. 聚丙烯酸酯
D. 聚硅氧烷
E. 聚乙二醇

正确答案：A、C、D。聚异丁烯；聚丙烯酸酯；聚硅氧烷

解析：本题考查经皮给药制剂的处方材料。聚异丁烯（A对）、聚丙烯酸酯（C对）、聚硅氧烷（D对）均为经皮吸收制剂常用的压敏胶。聚乙烯醇（B错）可用作黏合剂，聚乙二醇（E错）可用作增塑剂，以上两者均不属于压敏胶。